患者，女，32岁。饱餐后出现上腹部剧痛伴恶心呕吐，呕后腹痛反而加重，服解痉剂无效。检査：体温39℃。心率120次/分，腹部紧张，有压痛、反跳痛，血清淀粉酶400U，血钙1.63mmol/L。应首先考虑的是
A. 急性心肌梗死
B. 溃疡病穿孔
C. 急性胰腺炎
D. 急性阑尾炎
E. 急性肠梗阻

正确答案：C。急性胰腺炎

解析：本例患者饱餐后突发剧烈上腹痛，腹膜刺激征阳性，而且有血清淀粉酶升高、血钙降低，应首先考虑为急性胰腺炎（C对）。急性心肌梗死（A错）患者在发病前数日有乏力，胸部不适，活动时心悸、气急、烦躁、心绞痛等前驱症状，患者疼痛部位是胸骨中下部，部分患者位于上腹部，易被误诊为胃穿孔、急性胰腺炎等急腹症，但急性心梗患者不会出现淀粉酶升高超过正常值3倍，而且不会有腹膜刺激征阳性，心电图可以明确诊断。溃疡病穿孔（B错）多有胃病史，腹膜刺激征阳性，但不会出现淀粉酶升高超过正常值的3倍，不会出现血钙降低。急性阑尾炎（D错）的典型症状是初期有中上腹或脐周疼痛，数小时后腹痛转移并固定于右下腹。急性肠梗阻（E错）的典型临床表现可以概括为痛、吐、胀、闭，即腹痛、呕吐、腹胀、大便不通，与本例症状和体征不符。